心理过程包括哪3个过程
A. 气质、性格和能力
B. 动力、活动和评价
C. 认识、情绪和意志
D. 认识、人格和活动
E. 动力、情绪和意志

正确答案：C。认识、情绪和意志